扩张型心肌病左右心室同时衰竭时，与临床症状和体征最有关的因素是
A. 静脉回流增加
B. 肺淤血减轻
C. 心排量减少
D. 心律失常
E. 心肌缺血

正确答案：B。肺淤血减轻

解析：扩张型心肌病左心衰竭时表现为肺淤血，若同时发生右心衰竭，则右心室向肺动脉内射血减少，使肺内血流量减少，肺淤血（B对）减轻，患者的临床症状反而减轻。静脉回流增加（A错）、心排量减少（C错）、心律失常（D错）及心肌缺血（E错）均为扩张型心肌病病理生理改变，但与题干不符。